RNA分子中和DNA分子中不同的碱基为
A. 腺嘌呤
B. 鸟嘌呤
C. 胸腺嘧啶
D. 尿嘧啶
E. 5-甲基胞嘧啶

正确答案：D。尿嘧啶

解析：本题考查RNA分子中的碱基。RNA分子中和DNA分子中不同的碱基为尿嘧啶（D对）。常见的嘌呤包括腺嘌呤（简写为A）和鸟嘌呤（简写为G），常见的嘧啶包括尿嘧啶（简写为U）、胸腺嘧啶（简写为T）和胞嘧啶（简写为C）。A、G、C和U是构成RNA的碱基，A、G、C和T是构成DNA的碱基。所以RNA分子中和DNA分子中不同的碱基为尿嘧啶。